称为“第一反抗期”
A. 新生儿期
B. 乳儿期
C. 婴儿期
D. 幼儿期
E. 学龄期

正确答案：D。幼儿期

解析：本题考查不同年龄阶段心理卫生。幼儿期（D对）：3岁到6～7岁的儿童处于幼儿期。7～8岁的儿童脑重已接近1300克。因此，7～8岁前是智力发展的关键期。语汇量和语法结构发生了质变。思维出现了简单的逻辑思维和判断推理，模仿力极强，并出现了独立的愿望，开始自行其是，称为“第一反抗期”。